患者，男，32岁。暴饮后出现脘腹胀满，疼痛拒按，身热，口干，大便干结，小便短赤，舌红苔黄厚腻，脉洪数。其证型是
A. 胃肠热结
B. 肝胆湿热
C. 肝气郁滞
D. 气滞血瘀
E. 痰食交阻

正确答案：A。胃肠热结

解析：患者暴饮后出现脘腹胀满，疼痛拒按，病为腹痛。肠胃热结，气机郁滞，腑气不通，不通则痛，故见脘腹胀满，疼痛拒按；热伤津液，故见口干，大便干结，小便短赤；舌红苔黄厚腻，脉洪数，发热均为实热之象，可诊断为胃肠热结证（A对），治法为通腑泄热，行气止痛。方药选用大承气汤加减。肝胆湿热（B错）的特点为上腹胀痛拒按，胁痛，或有发热，恶心呕吐，目黄身黄，小便短黄，大便不畅。肝气郁滞（C错）的特点为突然中上腹痛，痛引两胁，或向右肩背部放射，恶心呕吐，口干苦，大便不畅。气滞血瘀（D错）的特点为胃脘疼痛如针刺，痛有定处，入夜尤甚。痰食交阻（E错）的特点为脘腹胀满、拒按，恶食，嗳腐吞酸。